患者，男，43岁。因上腹部不适，食欲减退，体重减轻1个月，而疑诊胃癌。为确诊，应首选的检查方法是
A. 癌胚抗原测定
B. 大便隐血试验
C. 胃液分析
D. X线钡餐检查
E. 胃镜检查

正确答案：E。胃镜检查

解析：胃镜检查（E对）可直接观察胃黏膜病变，是目前确诊胃癌的首选检查方法。癌胚抗原（A错）在部分胃癌病人中可升高，但目前仅作为判断预后和治疗效果的指标。大便隐血试验（B错）常用于测定消化道出血。胃液分析（C错）可用于胃癌的辅助诊断。X线钡餐检查（D错）可能发现胃内的溃疡及隆起型病灶，分别呈龛影或充盈缺损，但难以鉴别其良恶性，常用于有胃镜检查禁忌症时。